实施主动安乐死的首要社会条件是
A. 家属的主动要求
B. 安乐死的合法化
C. 患者的主动要求
D. 能够减轻患者的痛苦
E. 维护患者的尊严

正确答案：B。安乐死的合法化

解析：目前，我国法律尚未干涉的唯有严格意义上的病人自愿放弃抢救或治疗（相当于自愿被动安乐死），主动安乐死则是违法的，而自愿主动安乐死则是人们追求安乐死的主要方式，也是至今人们争论不已的。我国第一例安乐死案例是王明成案，王明成母亲夏素文因肝病晚期而饱受病痛折磨，王明成请求主治医师蒲连升为王母实施“安乐死”，蒲连升在其一再哀求下给夏素文用了若干冬眠灵注射药，夏素文死亡，后两人因涉嫌故意杀人罪被逮捕，直到5年后最高人民法院才宣告他们无罪，但却并非以认可安乐死合法性而结案，仅仅是因为所用冬眠灵剂量较小、不足以导致夏素文死亡，才未被判定为犯罪，但其实施“安乐死”的行为仍明确被判为违法。17年后，王明成不堪晚期胃癌等各种疾病的折磨，向西安交大附属第二医院及主治医师提出了安乐死的请求，但医方依据法律无允许安乐死规定加以拒绝。因此，即使实施主动安乐死能够减轻患者的痛苦（D错）、家属和患者主动要求（AC错）也是违法的，是不能被实施的，实施主动安乐死的首要社会条件是安乐死的合法化（B对）。维护患者的尊严（E错）是主张安乐死观点者的伦理依据，此观点认为安乐死是对人性更深层次的理解，是对人权更高层次的尊重。